黑色素瘤是
A. 原位癌
B. 良性肿瘤
C. 恶性肿瘤
D. 交界肿瘤
E. 瘤样病变

正确答案：C。恶性肿瘤

解析：黑色素瘤是起源于黑色素细胞的高度恶性的肿瘤（C对）。瘤样病变（E错）是指外观似肿瘤，但实质并不是肿瘤的一种良性病变。